治疗水疱型脚癣宜选用
A. 阿昔洛韦软膏
B. 维A酸乳剂
C. 氢化可的松软膏
D. 复方苯甲酸酊
E. 炉甘石洗剂

正确答案：D。复方苯甲酸酊

解析：本题考查手足真菌感染治疗药。治疗水疱型脚癣宜选用复方苯甲酸酊（D对）。水疱型足癣可外搽复方苯甲酸酊、十一烯酸软膏。阿昔洛韦软膏（A错）用于单纯疱疹病毒所致的感染。维A酸乳剂（B错）用于中度痤疮。氢化可的松软膏（C错）用于过敏性皮炎、湿疹、神经性皮炎、脂溢性皮炎及瘙痒症等。炉甘石洗剂（E错）用于冻伤。